对于新的或严重的药品不良反应应于发现之日起几天内报告
A. 3天
B. 5天
C. 7天
D. 及时报告
E. 15天

正确答案：E。15天

解析：医疗机构根据《药品不良反应管理办法》对已知新发生的不良反应的上报时限为15天（E对）。